女性，26岁。10天来全身皮肤出血点伴牙龈出血来诊。化验plt35×10⁹/L，临床诊断为慢性特发性血小板减少性紫癜（ITP）。下列支持ITP诊断的实验室检查是
A. 凝血时间延长
B. 血块收缩良好
C. 抗核抗体阳性
D. 骨髓巨核细胞增多，产板型增多
E. 骨髓巨核细胞增多，幼稚颗粒型增多

正确答案：E。骨髓巨核细胞增多，幼稚颗粒型增多

解析：患者已诊断为慢性特发性血小板减少性紫癜（ITP），支持ITP诊断的实验室检查有血小板计数减少、平均体积偏大、出血时间延长，血块收缩不良（B错），血小板功能一般正常；凝血时间（A错）、凝血酶原时间及部分活化凝血活酶时间正常；骨髓巨核细胞数量正常或增加，发育成熟障碍，幼稚颗粒型增多，产板型减少（E对D错）。抗核抗体阳性（P817）（C错）主要见于系统性红斑狼疮。